青霉素的主要抗菌作用机制是
A. 抑制胞壁黏肽合成
B. 抑制二氢叶酸还原酶
C. 抑制菌体蛋白质合成
D. 抑制RNA多聚酶
E. 增加胞质膜通透性

正确答案：A。抑制胞壁黏肽合成

解析：本题考查青霉素的作用机制。青霉素的主要抗菌作用机制是抑制胞壁黏肽合成（A对）。青霉素的抗菌作用机制是干扰敏感细菌细胞壁黏肽的合成，使细菌细胞壁缺损，丧失屏障作用，进而变形、裂解。